乌鸡白凤丸既能调经止带，又能
A. 散寒止带
B. 舒肝理气
C. 理气健脾
D. 补气养血
E. 温阳散寒

正确答案：D。补气养血

解析：本题考查的是乌鸡白凤丸的功能。乌鸡白凤丸既能调经止带，又能补气养血（D对）。乌鸡白凤丸：【功能】补气养血，调经止带。七制香附丸：【功能】舒肝理气（B错），养血调经。桂枝：【性能特点】本品辛散温通，甘温助阳。温通流畅，温助一身之阳气，流畅一身之血脉。入肺、膀胱经，善散风寒而解在表之风寒或风邪。入心经与血分，善温通助阳、散寒邪（E错）、通血脉、畅胸阳、温化水湿、止疼痛。发汗不及麻黄，长于助阳与流畅血脉。既走表，又走里，凡风寒表证无论虚、实皆宜，凡寒证无论虚、实或外寒直中或阳虚内生皆可。既入气分又入血分，血瘀有寒与阳虚水停用之为宜。功能为散寒止带（A错）或理气健脾（C错）的中成药，2022年考试指南未明确说明。